下列各项，与心有关的是
A. 生之本
B. 气之本
C. 后天之本
D. 先天之本
E. 罢极之本

正确答案：A。生之本

解析：《素问·六节藏象论》：“心者，生之本（A对）（心主血脉、主藏神，主宰人体整个生命活动），神之变也…肺者，气之本（B错）（肺主一身之气），魄之处也…肾者，主蛰，封藏之本（肾主藏精，为先天之本）（D错），精之处也…肝者，罢极之本（E错）（肝主藏血，肝血充足，筋力强健，运动灵活，则能耐受疲劳）…魂之居也…脾胃大肠小肠三焦膀胱者，仓廪之本（脾胃运化水谷，化生水谷精微，为后天之本）（C错），营之居也”。